滴虫性阴道炎
A. 咪康唑
B. 甲硝唑
C. 庆大霉素
D. 聚甲酚磺醛
E. 曲古霉素

正确答案：B。甲硝唑

解析：本题考查阴道炎治疗药。滴虫性阴道炎的主要治疗药物为硝基咪唑类药物。初始治疗可选择甲硝唑（B对）2g ，单次口服；或替硝唑2g, 单次口服；或甲硝唑400mg, 每日2次，连服7日。口服药物的治愈率达90%～95%。咪康唑（A错）为真菌性阴道炎首选药。庆大霉素（C错）适用于敏感革兰阴性杆菌，如大肠埃希菌、克雷伯菌属、铜绿假单胞菌以及葡萄球菌甲氧西林敏感株所致的严重感染，如败血症等。聚甲酚磺醛（D错）用于滴虫、细菌、真菌引起的阴道感染。曲古霉素（E错）用于滴虫、阿米巴原虫及念珠菌混合感染阴道炎。